有关局部振动对机体的影响，以下错误的是
A. 对神经系统能产生影响
B. 可以引起高频段听力下降
C. 可以出现雷诺征
D. 可以引起肌无力、肌疼痛、肌萎缩
E. 可以引起心血管系统的改变

正确答案：B。可以引起高频段听力下降

解析：本题考查局部振动对机体的影响。手传振动可以引起外周循环功能改变，外周血管发生痉挛（E对），出现手传振动主要危害手臂振动病的典型临床表现发作性手指变白。振幅大，冲击力强的振动，往往引起骨、关节的损害，亦可见手部肌肉萎缩、掌挛缩病（D对）等。长期接触较强的手传振动，可以引起外周和中枢神经系统（A对）的功能改变手臂振动病的典型表现是振动性白指，又称职业性雷诺现象（C对），是诊断本病的重要依据。高频段听力下降是噪声性耳聋的早期症状（B错，为本题正确答案）。